治疗睾丸偏坠胀痛，应选用
A. 丁香
B. 细辛
C. 花椒
D. 小茴香
E. 高良姜

正确答案：D。小茴香

解析：该题考查小茴香的应用。丁香具有温中降逆，散寒止痛，温肾助阳的功效（A错）。细辛具有解表散寒，祛风止痛，通窍，温肺化饮的功效（B错）。花椒具有温中止痛，杀虫止痒的功效（C错）。小茴香具有散寒止痛，理气和胃的功效，味辛，性温，能温肾暖肝，散寒止痛，可治肝气郁滞，睾丸偏坠胀痛（D对）。高良姜具有散寒止痛，温中止呕的功效（E错）。